某女，5岁。母亲诉患儿饭量比同龄孩子少，但饮水较多，且常说口干，平时容易发脾气，手足心热，大便偏干，小便黄。诊察见患儿毛发皮肤失于润泽，舌红，舌苔花剥，脉细数。中医辨证是
A. 脾失健运
B. 脾胃气虚
C. 胃阴不足
D. 脾胃湿热
E. 肝胃不和

正确答案：C。胃阴不足

解析：本题考查的是厌食的辨证论治。某女，5岁。母亲诉患儿饭量比同龄孩子少，但饮水较多，且常说口干，平时容易发脾气，手足心热，大便偏干，小便黄。诊察见患儿毛发皮肤失于润泽，舌红，舌苔花剥，脉细数。中医辨证是胃阴不足（C对）。厌食，是指脾胃受纳运化功能失常所致的疾病，以较长时间的厌恶进食，食量减少为临床特征。西医学的厌食症可参考此内容辨证论治。（一）脾失健运证（A错）：【症状】食欲不振，厌恶进食，食而乏味，或伴胸脘痞闷，嗳气泛恶，偶尔多食则脘腹饱胀，大便不调，形体尚可，精神如常。舌淡红，苔薄白或薄腻，脉尚有力。（二）脾胃气虚证（B错）：【症状】不思进食，食不知味，神倦多汗，大便溏薄夹不消化食物，面色少华，形体偏瘦，肢倦乏力。舌淡，苔薄白，脉缓无力。（三）脾胃阴虚证：【症状】不思进食，食少饮多，皮肤失润，大便偏干，小便短黄，甚或烦躁少寐，手足心热。舌红少津，苔少或花剥，脉细数。脾胃湿热（D错）证的临床表现，常见面目皮肤发黄，鲜明如橘色，脘腹胀满，不思饮食，厌恶油腻，恶心呕吐，体倦身重，发热，口苦，尿少而黄，舌苔黄腻，脉濡数。肝胃不和（E错）证的临床表现，常见胸胁胀满，善太息，胃脘胀满作痛，嗳气吞酸，嘈杂或呕恶，苔薄黄，脉弦。肝郁气滞，故胸胁胀痛、善太息。肝气犯胃，胃失和降，故嗳气、吞酸、嘈杂、呕恶。胃脘胀满作痛为气滞疼痛的特点，亦由肝气犯胃所致。